由于小儿为“纯阳之体”，“稚阴之体”，临床上易表现出的证候是
A. 热证
B. 寒证
C. 实证
D. 虚证
E. 瘀证

正确答案：A。热证

解析：该题考查小儿生理病理特点。《宣明方论·小儿门》：大概小儿病者纯阳，热多冷少也；《医学正传·小儿科》：褪袱小儿，体属纯阳，所患热病最多。 因此小儿为“纯阳之体”“稚阴之体”，临床上易表现出的证候为热证（A对）。小儿“稚阳未充”，易见阳气虚衰，表现为寒证（B错）。小儿患病，病之初常见邪气呈盛势的实证（C错），但由于其正气易伤而虚，可迅速出现正气被损的虚证或虚实相兼之证（D错）。